构成黏膜上皮的主要细胞是
A. 朗格汉斯细胞
B. 梅克尔细胞
C. 角质形成细胞
D. 组织细胞
E. 成纤维细胞

正确答案：C。角质形成细胞

解析：口腔黏膜上皮为复层鳞状上皮，由角质形成细胞和非角质形成细胞构成，其中绝大多数细胞为角质形成细胞。角质形成细胞的命名来自于细胞的生物化学特点，即在此种细胞的生命过程中，不断地形成被称为角蛋白的蛋白质。有人称角蛋白为角质。掌握“口腔黏膜基本结构”知识点。